关于甲亢手术治疗，下列哪项正确
A. 通常需切除双侧甲状腺腺体的60%～70%
B. 处理甲状腺上极血管时应远离甲状腺上极
C. 结扎甲状腺下动脉要尽量离开腺体背面靠近颈总动脉
D. 甲状腺峡部要保留
E. 止血充分时，术野可不放置引流

正确答案：C。结扎甲状腺下动脉要尽量离开腺体背面靠近颈总动脉

解析：喉返神经与甲状腺下动脉在甲状腺侧叶下极背面关系比较复杂，在分离、结扎甲状腺下动脉时，如果不远离腺体的背面、不靠近颈总动脉，则容易挫伤或扎住喉返神经。因此，结扎甲状腺下动脉要尽量离开腺体背面靠近颈总动脉（C对）。甲状腺大部切除术通常需切除双侧腺体的80%～90%（A错），并同时切除峡部（D错），每侧仅保留约3～4g腺体。喉上神经外支伴行于甲状腺上动脉，在距甲状腺上极0.5～1.0cm处方离开动脉，因此处理甲状腺上极血管时应紧贴甲状腺上极（B错）。为防止术后血肿压迫气管导致窒息，术野应常规放置引流（E错），术后床旁应备气管切开包。